患者，女，60岁。体弱多病，形体消瘦，气短乏力，纳食不香，头晕心慌，面色苍白，饭后腹胀，经查诊断为胃下垂。应选用的药物是
A. 味辛升浮药
B. 味甘升浮药
C. 味甘沉降药
D. 味酸沉降药
E. 味苦沉降药

正确答案：B。味甘升浮药

解析：患者体弱多病，形体消瘦，为正气虚弱，甘味药能补能和能缓，宜选用甘味药提升正气，同时又有胃下垂的症状，应用升浮药，以升阳举陷（B对）。辛：“能散能行”，多用治表证及气血阻滞之证（A错）。酸：“能收能涩”，多用治自汗盗汗、肺虚久咳、久泻久痢、遗精滑精、遗尿尿频、崩带不止等滑脱不禁的病证。苦：“能泄、能燥、能坚”，多用治火热证、喘咳、呕恶、便秘、湿证、阴虚火旺等证。沉降药作用趋向多主下行向内（CDE错）